情绪是人根据什么而产生的态度体验
A. 生理
B. 心理
C. 态度
D. 愿望
E. 对客观事物是否符合自身需要

正确答案：E。对客观事物是否符合自身需要